属于棘白菌素类的抗真菌药物是
A. 灰黄霉素
B. 氟胞嘧啶
C. 两性霉素B
D. 卡泊芬净
E. 氟康唑

正确答案：D。卡泊芬净

解析：本题考查棘白菌素类抗真菌药。属于棘白菌素类的抗真菌药物是卡泊芬净（D对）。棘白菌素类抗真菌药物：卡泊芬净、米卡芬净、阿尼芬净。灰黄霉素（A错）是非多烯类抗真菌药。氟胞嘧啶（B错）其他抗真菌药。两性霉素B（C错）为多烯类广谱抗真菌药。氟康唑（E错）为三唑类抗菌药。